正态分布线下，横轴上从均数μ到μ－1.96σ的面积为
A. 0.45
B. 0.475
C. 0.9
D. 0.95
E. 0.975

正确答案：B。0.475

解析：本题考查正态分布的相关内容。正态分布曲线下的面积分布规律：无论μ和σ取什么值，正态曲线与横轴间的面积总等于1。在μ±1.96σ范围内曲线下面积为0.9500，则μ－1.96σ的面积为0.9500/2=0.475（B对ACDE错）。